根据我国居民膳食特点，矿物质中严重摄入不足的是
A. 钙和铁
B. 镁和锰
C. 铁和磷
D. 锌和钼
E. 硒和钠

正确答案：A。钙和铁